氯丙嗪对下列哪种病因所致的呕吐无效
A. 顽固性呃逆
B. 恶性肿瘤
C. 尿毒症
D. 吗啡
E. 晕动症

正确答案：E。晕动症

解析：氯丙嗪对多种药物和疾病引起的呕吐具有显著的镇吐作用。对顽固性呃逆具有显著疗效。对晕动症无效。掌握“氯丙嗪”知识点。